关于关节的基本构造，正确的是
A. 关节囊、关节腔、关节面、关节韧带
B. 关节腔、关节囊、关节内软骨
C. 关节面、关节囊、关节内韧带
D. 关节面、关节囊、关节腔
E. 关节囊、关节腔、关节面、关节盘

正确答案：D。关节面、关节囊、关节腔

解析：关节的基本结构有关节面、关节囊、关节腔（D对），关节的辅助结构有韧带、关节盘、关节唇、滑膜襞、滑膜囊。